组牙功能（牙合）的咬合接触是指
A. 前、后牙均无接触
B. 非工作侧多个后牙接触
C. 工作侧多个后牙接触
D. 工作侧和非工作侧均无接触
E. 工作侧和非工作侧均有接触

正确答案：C。工作侧多个后牙接触

解析：本题考查组牙功能（牙合）。组牙功能（牙合）的咬合接触是指工作侧多个后牙接触（C对）。1.组牙功能（牙合）简称组牙（牙合）。组牙（牙合）的特点：ICP时双侧后牙交错接触，前牙不接触或者轻接触；前伸（牙合）时前牙接触，后牙不接触或者轻接触；侧方（牙合）时工作侧后牙接触，非工作侧后牙不接触或者轻接触。2.尖牙保护（牙合）简称尖牙（牙合）。尖牙（牙合）的特点：ICP时双侧后牙交错接触，前牙不接触或者轻接触；前伸（牙合）时前牙接触，后牙不接触或者轻接触；侧方（牙合）时工作侧仅有上下颌尖牙接触，其余后牙均不接触。